孕2月孕妇，平时体健，昨晚始下腹痛伴出血，量多，今日出血仍多并感头晕，眼花，来医院途中昏倒，急救入院，检查：外阴有大量血迹，阴道内积血块，宫颈口开，内可触及软性胚胎组织，宫体2月妊娠大小，面色苍白，血压9.3/7.3kPa，（70/50mmHg），脉搏120次/分最可能诊断
A. 难免流产伴休克
B. 不全流产伴休克
C. 前置胎盘伴休克
D. 输卵管妊娠伴休克
E. 胎盘早剥伴休克

正确答案：A。难免流产伴休克

解析：不全流产时子宫明显小于停经月份，难免流产时子宫与停经月份相等或略小。不全流产有组织物排出，难免流产还没有组织物排出。本例子宫大小与停经月份相等，故选A。掌握“自然流产”知识点。